对一个地区全体居民进行高血压普查资料分析，可计算当地的
A. 高血压患病率
B. 高血压发病率
C. 高血压家庭续发率
D. 高血压病死率
E. 高血压罹患率

正确答案：A。高血压患病率

解析：对全体居民的一次调查是一个特定时点，不是一个长时间的观察，所以只能计算患病率，而且高血压是一个慢性疾病，描述病程较长的慢性病的发生或流行情况适宜用患病率（A对）。发病率是一定期间内，特定人群中某病新病例出现的频率，资料来源为：疾病报告、疾病监测、队列研究（B错）。家庭续发率常用于局部范围内发生传染病时的流行病学调查，不能用于高血压病（C错）。病死率常用于急性传染病，较少用于慢性病高血压病（D错）。罹患率与发病率一样也是测量人群新发病例发生频率的指标，常用于疾病暴发或流行时的调查，也不适宜用于高血压病（E错）。